有机磷农药主要损害
A. 内分泌系统
B. 神经系统
C. 呼吸系统
D. 皮肤
E. 循环系统

正确答案：B。神经系统